关于健康相关生命质量（HRQOL）测评，错误的说法是
A. 在HRQOL测评中，认知功能不仅是不可缺少的内容，而且是一个高度敏感的指标
B. 它不仅关注被测对象的存活时间，而且更关注其生存质量
C. 它是从躯体、心理、社会等方面对被测对象主观感受所进行的一种综合测评
D. 它的测评对象可以是病人，也可以是健康者
E. 被测对象的生理、心理和社会功能状态能通常是HRQOL测评的重要内容

正确答案：A。在HRQOL测评中，认知功能不仅是不可缺少的内容，而且是一个高度敏感的指标